患者女性，31岁，左下后牙、左下颌角区反复肿胀3个月，开口困难。检查开口度一指半，阻生牙牙龈充血糜烂，挤压有少量脓液溢出，嚼肌区膨隆明显，质硬，轻度压痛。此患者最可能的诊断为
A. 急性智齿冠周炎
B. 左嚼肌间隙脓肿
C. 左下颌骨骨结核
D. 左嚼肌区放线菌病
E. 左下颌骨边缘性骨髓炎

正确答案：E。左下颌骨边缘性骨髓炎

解析：本题考查边缘性颌骨骨髓炎。咬肌间隙感染长期脓液蓄积，可形成下颌支的边缘性骨髓炎（E对）。智牙冠周炎，阻生牙牙龈充血糜烂，挤压有脓液溢出（A错）。智牙冠周炎引发咬肌间隙感染，以下颌支和下颌角为中心的咬肌区肿胀、变硬、压痛伴明显张口受限（B错）。颌骨骨结核侵犯软组织和皮肤后，可在骨膜下形成冷脓肿，形成久治不愈的瘘管，有稀薄脓性分泌物溢出，间有死骨小碎块，脓液涂片可见抗酸杆菌（C错）。颌骨放线菌病，好发于下颌角及下颌支，组织呈硬板状，多发性脓肿或瘘孔，脓液中可见硫黄颗粒等（D错）。